单颌全口义齿人工牙排列与咬合关系说法正确的是
A. 加大前牙覆（牙合）
B. 必须要排反（牙合）
C. 减小正中自由的范围
D. 增大侧向（牙合）力
E. 后牙尽量排在牙槽嵴顶上

正确答案：E。后牙尽量排在牙槽嵴顶上

解析：人工牙排列与咬合关系：为了使单颌全口义齿尽可能达到平衡（牙合），在排牙时应注意减小前牙覆（牙合），以利用获得前伸（牙合）平衡。后牙尽量排在牙槽嵴顶上，必要时可排反（牙合）。可修改后（牙合）面形态，增大正中自由的范围，减小侧向（牙合）力。掌握“单颌全口义齿”知识点。